服用阿托品治疗胃肠绞痛出现口干等症状，该不良反应是
A. 过敏反应
B. 首剂效应
C. 副作用
D. 后遗效应
E. 特异性反应

正确答案：C。副作用

解析：本题考查药品的不良反应。服用阿托品治疗胃肠绞痛出现口干等症状，该不良反应是副作用（C对）。副作用是指在药物按正常用法用量使用时，出现的与治疗目的无关的不适反应。如阿托品用于解除胃肠痉挛时，会引起口干、心悸、便秘等副作用。过敏反应（A错）是指机体受药物刺激所发生的异常免疫反应，引起机体生理功能障碍或组织损伤。首剂效应（B错）是指一些患者在初服某种药物时，由于机体对药物作用尚未适应而引起不可耐受的强烈反应，例如患者在初次服用哌唑嗪时所引起的反应。后遗效应（D错）是指在停药后血药浓度已降低至最低有效浓度以下时仍残存的药理效应。特异质反应也称特异性反应（E错），是指少数特异体质患者对某些药物反应异常敏感。